副溶血性弧菌食物中毒好发食品是
A. 奶及奶制品
B. 鱼虾蟹贝类等
C. 禽蛋类
D. 面包，面条等食品
E. 臭豆腐，豆酱等

正确答案：B。鱼虾蟹贝类等

解析：副溶血性弧菌食物中毒食品种类：主要是海产品，以带鱼、墨鱼、虾、蟹、贝和海蜇较为多见，其次为直接或间接被本菌污染的其他食品，如腌渍或腌制食品等。掌握“食品安全”知识点。